髁突软骨从胚胎12周开始出现，一直持续到
A. 20岁
B. 18岁
C. 16岁
D. 12岁
E. 6岁

正确答案：A。20岁

解析：髁突软骨出现在胚胎第12周，这部分软骨覆盖在髁突头部，一直持续到20岁，维持下颌骨的生长。掌握“唾液腺与颌骨的发育”知识点。